某女，56岁。患风湿顽痹20年，近日关节拘挛疼痛加重。宜选用的药是
A. 防己
B. 雷公藤
C. 伸筋草
D. 千年健
E. 徐长卿

正确答案：B。雷公藤

解析：本题考查的是雷公藤的主治病证。某女，56岁。患风湿顽痹20年，近日关节拘挛疼痛加重。宜选用的药是雷公藤（B对）。雷公藤：【主治病证】（1）风湿顽痹，拘挛疼痛。（2）疔疮肿毒，腰带疮，湿疹，麻风，疥癣。防己（A错）：【主治病证】（1）风湿痹痛，尤以热痹为佳。（2）水肿，腹水，脚气浮肿，小便不利。伸筋草（C错）：【主治病证】（1）风湿痹痛，关节酸痛，屈伸不利。（2）跌打损伤。千年健（D错）：【主治病证】风寒湿痹，腰膝冷痛，下肢拘挛麻木。徐长卿（E错）：【主治病证】（1）风湿痹痛，脘腹痛，牙痛，术后痛，癌肿痛。（2）跌打肿痛。（3）风疹，湿疹，顽癣。（4）毒蛇咬伤。